男，20岁，反复发作全身抽搐伴神智丧失1年，约1个月发作1次，从未服药治疗，既往有脑外伤史，查体，未见明显神经系统阳性体征，对该患者的发作性症状的正确处理原则是
A. 服药后不发作即停药
B. 首选多药联合治疗
C. 每日总量一次性服用
D. 首选大剂量冲击
E. 首选单药治疗

正确答案：E。首选单药治疗

解析：年轻男性，有脑外伤史，反复发作全身抽搐伴神智丧失1年，约1个月发作1次（重复性），根据患者的病史、临表、体征，考虑为癫痫。半年内发作两次以上者，一经诊断明确，就应用药。根据药物的半衰期可将日剂量分次服用（C错）。抗癫痫药物治疗的基本原则是尽可能单药治疗（E对B错），70%-80%左右的癫痫患者可以通过单药治疗控制发作。单药治疗应从小剂量开始（D错），缓慢增量至能最大限度地控制癫痫发作而无不良反应或不良反应很轻，即为最低有效剂量。控制发作后必须坚持长期服用（A错），除非出现严重的不良反应，不宜随意减量或停药，以免诱发癫痫持续状态（P361-365）。